除另有规定外，水丸的溶散时限为
A. 30min
B. 45min
C. 60min
D. 90min
E. 120min

正确答案：C。60min

解析：本题考查的是丸剂的溶散时限。除另有规定外，水丸的溶散时限为60min（C对）。丸剂的溶散时限：除另有规定外，小蜜丸、水蜜丸和水丸应在1小时内全部溶散；浓缩丸和糊丸应在2小时（E错）内全部溶散；滴丸应在30分钟（A错）内全部溶散，包衣滴丸应在1小时内全部溶散。蜡丸照崩解时限检查法片剂项下的肠溶衣片检查法检查，在盐酸溶液中（9→1000）检查2小时，不得有裂缝、崩解或软化现象，再在磷酸盐缓冲液（pH6.8）中检查，1小时内应全部崩解。除另有规定外，大蜜丸及研碎、嚼碎后或用开水、黄酒等分散后服用的丸剂不检查溶散时限。溶散时限为45min（B错）或90min（D错）的剂型，2022年考试指南未明确说明。